患者，女性，65岁，拔牙后3个月愈合尚可，但有一骨棱压痛明显，最佳的处理方式是
A. 观察，无需处理
B. 局部按摩
C. 局部理疗
D. 行牙槽突修整术
E. 修复时加大基托

正确答案：D。行牙槽突修整术

解析：本题考查牙槽外科。患者拔牙后3个月愈合尚可（牙槽突改建趋于稳定），但有一骨棱压痛明显，最佳的处理方式是行牙槽突修整术（D对）。拔牙后牙槽骨吸收不全，骨尖、嵴有压痛者，可行牙槽突修整术进行修整（A错）。局部按摩（B错）、局部理疗（C错）及修复时加大基托（E错）无法去除骨棱骨嵴，消除疼痛。